脑脊液容纳在
A. 硬膜外隙
B. 硬膜与蛛网膜之间
C. 蛛网膜下隙
D. 软膜与脑之间
E. 内囊

正确答案：C。蛛网膜下隙

解析：脑脊液容纳在脑室系统、蛛网膜下隙（C对）和脊髓中央管内。